膳食纤维是
A. 可消化吸收的多糖
B. 可消化吸收的寡糖
C. 不被消化吸收的寡糖
D. 不被消化吸收的多糖
E. 单糖类物质

正确答案：D。不被消化吸收的多糖